某市共有4个城区，各城区社会经济状况、小学校数量均不同。开展调查时，最佳的抽样方法是
A. 单纯随机抽样
B. 系统抽样
C. 分层抽样
D. 整群抽样
E. 多级式抽样

正确答案：E。多级式抽样